曲池穴主治的病证是
A. 咳喘，口㖞
B. 咳嗽，无脉症
C. 瘾疹，湿疹
D. 无汗，多汗
E. 惊悸，怔忡

正确答案：C。瘾疹，湿疹

解析：该题主要考察腧穴的主治，是记忆类题目。曲池为手阳明大肠经腧穴，主治①手臂痹痛，上肢不遂；②热病；③眩晕；④腹痛、吐泻等肠胃病证；⑤咽喉肿痛、齿痛、目赤肿痛等五官热性病证；⑥瘾疹、湿疹（C对）、瘰疬等皮肤外科病证；⑦癫狂。